含有1个手性碳的芳基烷胺类钙通道阻滞剂用于室上性心动过速治疗的药物是
A. 硝苯地平
B. 苯磺酸氨氯地平
C. 盐酸氟桂利嗪
D. 盐酸维拉帕米
E. 盐酸地尔硫䓬

正确答案：D。盐酸维拉帕米

解析：本题考查维拉帕米。维拉帕米（D对）是含有1个手性碳的芳基烷胺类钙通道阻滞剂，临床可用于室上性心动过速的治疗。硝苯地平（A错）结构对称，不含手性碳。苯磺酸氨氯地平（B错）是含有1个手性碳的二氢吡啶类钙通道阻滞剂。盐酸氟桂利嗪（C错）是哌嗪类钙离子拮抗剂。地尔硫䓬（E错）是含有2个手性碳原子的苯硫氮䓬钙离子通道阻滞剂。